关于酚妥拉明的适应证，正确的是
A. 支气管哮喘
B. 外周血管痉挛性疾病
C. 慢性心肌梗死
D. 肾功能衰竭
E. ⅠⅡ级高血压

正确答案：B。外周血管痉挛性疾病

解析：酚妥拉明应用于：①外周血管痉挛性疾病（B对）②静滴去甲肾上腺素药液外漏③急性心肌梗死和顽固性充血性心力衰竭④休克⑤肾上腺嗜铬细胞瘤。